乙型肝炎最主要的传染源是
A. 急性期患者
B. 慢性乙型肝炎患者
C. HBV携带者
D. 急性期患者及慢性乙型肝炎患者
E. 慢性期患者及HBV携带者

正确答案：C。HBV携带者

解析：本题考查乙型肝炎最主要的传染源。乙肝的传染源主要是急性、慢性乙肝病人（包括不同类型慢性乙型肝炎、肝硬化和肝癌病人）和无症状病毒携带者。其中最主要的传染源是HBV携带者（C对ABDE错）。